可摘局部义齿的组成中不包括
A. 人工牙
B. 基托
C. 固位体
D. 预备体
E. 连接体

正确答案：D。预备体

解析：可摘局部义齿一般是由人工牙、基托、固位体和连接体等部件组成。掌握“局部义齿人工牙及基托”知识点。